属于二类医疗器械产品的是
A. 输血器
B. 纱布绷带
C. 微波治疗仪
D. 一次性使用输液器
E. 医用脱脂纱布

正确答案：E。医用脱脂纱布